《药品经营质量管理规范》经营中药饮片的零售药店不同批号的中药饮片装斗前应当
A. 验收检查
B. 定期清斗
C. 清斗并记录
D. 正名正字
E. 复核

正确答案：C。清斗并记录

解析：本题考查的是药品零售企业药品陈列要求。《药品经营质量管理规范》经营中药饮片的零售药店不同批号的中药饮片装斗前应当清斗并记录（C对）。药品零售企业药品的陈列应当符合以下要求：按剂型、用途以及储存要求分类陈列，并设置醒目标志，类别标签字迹清晰、放置准确；药品放置于货架（柜），摆放整齐有序，避免阳光直射；处方药、非处方药分区陈列，并有处方药、非处方药专用标识；处方药不得采用开架自选的方式陈列和销售；外用药与其他药品分开摆放；拆零销售的药品集中存放于拆零专柜或者专区；第二类精神药品、毒性中药品种和罂粟壳不得陈列；冷藏药品放置在冷藏设备中，按规定对温度进行监测和记录，并保证存放温度符合要求；中药饮片柜斗谱的书写应当正名正字（D错）；装斗前应当复核（E错），防止错斗、串斗；应当定期清斗（B错），防止饮片生虫、发霉、变质；不同批号的饮片装斗前应当清斗并记录；经营非药品应当设置专区，与药品区域明显隔离，并有醒目标志。